rRNA的转录由下列哪种酶催化
A. RNA聚合酶Ⅰ
B. 反转录酶
C. RNA聚合酶Ⅱ
D. RNA聚合酶全酶
E. RNA聚合酶Ⅲ

正确答案：E。RNA聚合酶Ⅲ